某战士参加抗洪抢险救灾中得到加重母亲重病的消息，十分焦虑，在电话中对父亲说“自古忠孝两难全”，这位战士的动机冲突为
A. 趋避冲突
B. 双避冲突
C. 多重趋避冲突
D. 双趋冲突
E. 双重趋避冲突

正确答案：D。双趋冲突

解析：某战士参加抢洪救灾时，接到家里电话，得知母亲病危，属于两个目标具有相同的吸引力，引起同样强度的动机，但由于受条件等因素的限制，无法同时实现，只能选在其一，为双趋冲突(D对）｡趋避冲突(A错）指一个人对同一事物同时产生两种动机，即向往得到它，同时又想拒绝和避开它｡双避冲突(B错）指一个人同时受到两种事物的威胁，产生同等强度的逃避动机，但迫于情势，必须接受其中一个，才能避开另一个，处于左右为难，进退维谷的紧张状态｡双重趋避式冲突(CE错）指人们常常会遇到多个目标，每个目标对自己都有利也都有弊，反复权衡拿不定主意所产生的冲突｡